下列除哪项外，均为阳明腑实证的临床表现
A. 高热不退
B. 日晡热甚
C. 身热不扬
D. 腑胀拒按
E. 大便秘结

正确答案：C。身热不扬

解析：身热不扬（C错，为本题正确答案）属发热之一种，指患者自觉发热，按其肌肤却不甚热的一种症状。可见身热稽留而热象不剧，或医生初扪病者体表不觉热甚，久则感到热盛灼手的表现，多见于湿温病，热为湿遏，以致发热在里，热势不扬，治宜用渗湿透热或清泄芳开之法。阳明腑实证里热蒸达，迫津外泄，故见高热（A对），汗出口渴。大肠属于阳明经，其气旺于日晡之时，故见日晡潮热（B对）。热结肠道，气机壅滞，肠中燥屎内结，腑气不通，津液耗伤，肠道失润故腹部硬满疼痛拒按（D对），大便秘结（E对）。